太阳病误下，出现下利不止，喘而汗出，脉促的，选用以下哪一方治疗
A. 麻杏石甘汤
B. 葛根汤
C. 黄芩汤
D. 葛根黄芩黄连汤
E. 桂枝人参汤

正确答案：D。葛根黄芩黄连汤

解析：从“太阳病”至“表未解也”为一段，言其下利仍以表证为主。太阳病，桂枝证，当用汗解，若用攻下，是属误治，故以“反”字标示之。医反下之、必伤及胃肠，因而下利不止。此时判断下利之属表属里，尚须根据脉证以凭之。若脉来急促或短促，知胃肠虽伤，但正气仍能抗邪，病机并不因下而内陷，仍欲还表而外出，如疾病重在表证未解，外邪内迫肠道而下利，则宜以解表为主，表解而利自止，如桂枝加葛根汤、可以取用。自“喘而汗出者”以下为另一段，说明表病误下后，病邪入里化热，其下利以里证为主。邪束于表，热传入里，下迫大肠，故利遂不止。里热壅盛，影响肺胃之气，不得清肃下降，则上逆而喘；外蒸于体表，则有汗出。由此可知肺与大肠相为表里之说信而有征。治宜解表清里，和中止利，方用葛根黄苓黄连汤（D对）。